尖牙位居牙弓前部，在咀嚼时构成第几类杠杆，能抵御较大的咀嚼力
A. 第Ⅰ类杠杆
B. 第Ⅱ类杠杆
C. 第Ⅲ类杠杆
D. 第Ⅳ类杠杆
E. 第Ⅴ类杠杆

正确答案：C。第Ⅲ类杠杆

解析：尖牙位居牙弓前部，在咀嚼时构成第Ⅲ类杠杆，能抵御较大的咀嚼力。掌握“咀嚼过程、类型，咀嚼周期及生物力”知识点。